选择人工前牙时主要要考虑什么因素，除了
A. 人工牙的大小
B. 人工牙的颜色
C. 人工牙的形态
D. 人工牙的质地
E. 人工牙的品牌

正确答案：E。人工牙的品牌

解析：本题考查选牙-人工前牙的选择。人工牙的品牌（E错，为本题的正确答案）对人工牙的选择并没有实质性的影响。前牙关系到患者的面部形态和美观，要注意前牙与面部形态的协调一致，考虑人工牙的大小（A对）、形态（C对）、颜色（B对）、质地（D对），人工牙有塑料牙和瓷牙两种，选择时要综合考虑。